维生素D400IU相当的μg数为
A. 20
B. 10
C. 5
D. 2
E. 1

正确答案：B。10

解析：本题考查营养性疾病预防控制。维生素D补充：婴儿（尤其是纯母乳喂养儿）生后数天开始补充维生素D400IU/d（10μg/d）。1IU维生素D=0.025μg维生素D，则：400×0.025=10μg（B对ACDE错）。